龋齿的主要致病菌是
A. 葡萄球菌
B. 变形杆菌
C. 变形链球菌
D. 放线菌
E. 乳酸杆菌

正确答案：C。变形链球菌